苯可引起
A. 再生障碍性贫血
B. 低色素性贫血
C. 溶血性贫血
D. 缺铁性贫血
E. 大细胞性贫血

正确答案：A。再生障碍性贫血

解析：本题考查苯对血液系统的影响。慢性苯中毒主要损害造血系统。最早和最常见的血象异常表现是持续性白细胞计数减少，主要是中性粒细胞减少，白细胞分类中淋巴细胞相对值可增加到40%左右。电镜检查可见血小板形态异常。严重中毒者骨髓造血系统明显受损，甚至出现再生障碍性贫血（A对BCDE错）、骨髓增生异常综合征（MDS）,少数可转化为白血病。